甲状腺滤泡状癌行甲状腺切除术后复发
A. 血清甲状腺球蛋白升高
B. 血清降钙素升高
C. 血清甲状旁腺素升高
D. 血清垂体促甲状腺激素升高
E. 血清T₃、T₄升高

正确答案：A。血清甲状腺球蛋白升高

解析：甲状腺滤泡状癌行甲状腺切除术后复发血清甲状腺球蛋白升高（A对）。这是因为当甲状腺癌滤泡癌出现复发或转移灶时，在TSH的刺激下血清内的甲状腺球蛋白会大大升高，这也是甲状腺切除术后监测TSH刺激后的甲状腺球蛋白水平的原理，TSH刺激后的血清甲状腺球蛋白升高往往提示甲状腺癌出现转移或者复发。血清降钙素升高（B错）主要出现于甲状腺髓样癌的情况中，甲状腺髓样癌来源于滤泡旁降钙素分泌细胞（C细胞）（P231），而降钙素主要由C细胞分泌，因此甲状腺髓样癌出现血清降钙素升高。血清甲状旁腺素升高（C错）主要出现于原发性甲状旁腺功能亢进症的情况中。血清垂体促甲状腺激素升高（D错）主要见于甲状腺功能减退的情况中，由于血清甲状腺激素降低，通过下丘脑-垂体-甲状腺激素轴的负反馈机制使血清垂体促甲状腺激素升高。血清T₃、T₄升高（E错）主要见于甲状腺功能亢进的情况中。